妊娠合并急性病毒性肝炎时，昏迷前期口服新霉素是为了
A. 预防感染
B. 减少游离氨及其他毒素的形成
C. 消除肠道内感染灶
D. 控制重症肝炎进展
E. 抑制需氧菌和厌氧菌

正确答案：B。减少游离氨及其他毒素的形成

解析：妊娠合并急性病毒性肝炎时，易进展为肝性脑病，其机制主要是由于肝功能损害，对氨的代谢能力减退，引起氨中毒。消化道是氨产生的主要部位，肠道氨主要来源于肠道产尿素酶的细菌对含氮物质的分解。昏迷前期口服新霉素可抑制肠道产尿素酶的细菌，从而减少游离氨及其他毒素的形成（B对），缓解肝性脑病。口服新霉素可起到预防感染（A错）和清除肠道内感染灶（C错）的目的，但由于它的肾毒性和耳毒性，临床上已很少使用。控制重症肝炎进展（D错）主要是利用人血红蛋白促进肝细胞再生，改善低蛋白血症；利用肝细胞生长因子、胰高血糖素加胰岛素疗法可促进肝细胞再生，而新霉素属于抗生素，对控制重症肝炎无明显作用。抑制需氧菌和厌氧菌（E错）选用头孢类第二、三代抗生素，而新霉素主要用于治疗需氧菌引起的感染。